适用于急性期焦虑患者短期服用的药物是
A. 劳拉西泮
B. 美金刚
C. 多塞平
D. 多奈哌齐
E. 左乙拉西坦

正确答案：A。劳拉西泮

解析：本题考查劳拉西泮。适用于急性期焦虑患者短期服用的药物是劳拉西泮（A对）。劳拉西泮为苯二氮䓬类药物，起效快，抗焦虑作用强，通常可在数分钟至数小时内缓解情绪症状和躯体症状，对急性期焦虑患者可考虑短期使用。美金刚（B错）单药或与多奈哌齐合用对中至重度AD患者有一定疗效。多塞平（C错）为三环类抗抑郁药。多奈哌齐（D错）为胆碱脂酶抑制剂，多用于治疗轻至中度AD患者。左乙拉西坦（E错）为抗癫痫药，育龄期妇女酌情选用。